椎管内面骨膜参与围成的是
A. 硬膜外隙
B. 蛛网膜下隙
C. 终池
D. 乙状窦
E. 硬膜下隙

正确答案：A。硬膜外隙

解析：脊髓的被膜由外向内分为硬脊膜、脊髓蛛网膜、软脊膜。最靠外的椎管内面骨膜和硬脊膜共同围成硬膜外隙（A对）。硬膜下隙（E错）为硬脊膜和脊髓蛛网膜之间的腔隙。蛛网膜下隙（B错）为脊髓蛛网膜和软脊膜之间的腔隙，终池（C错）为脊髓下端至第2骶椎之间扩大的蛛网膜下隙。乙状窦（D错）为硬脑膜窦，是硬脑膜两层分开，内面衬以内皮细胞形成的。